下列各项，不属于低钾血症表现的是
A. 肌无力
B. 频发室性早搏
C. 血气分析pH值低于正常
D. 代谢性碱中毒
E. 嗜睡

正确答案：C。血气分析pH值低于正常

解析：低钾血症时，血pH值在正常高限或＞7.45，但肾小管酸中毒、严重腹泻、糖尿病酮中毒等伴低钾血症患者，血pH常降低（C对）。低钾血症的骨骼肌表现，软弱、乏力；血清钾＜2.5mmol/L时，全身肌无力（A错），软瘫，腱反射减弱或消失，甚而膈肌、呼吸肌麻痹，呼吸困难、吞咽困难，重者可窒息。病程较长者常伴肌纤维溶解、坏死、萎缩和神经退变等病变。循环系统表现，早期由于心肌应激性增强，可发生各种心律失常（B错）。酸碱平衡紊乱表现，钾缺乏时细胞内缺钾，细胞外Na⁺和H+进入细胞内，肾远曲小管K⁺与Na⁺交换减少而H⁺与Na⁺交换增多，故导致代谢性碱中毒（D对）、细胞内酸中毒、反常性酸性尿。中枢神经系统，轻者表现为萎廉不振，重者反应迟钝，定向力障碍，嗜睡（E对）。